丹痧的病变脏腑主要在
A. 肺、胃
B. 肺、脾
C. 脾、胃
D. 肺、大肠
E. 心、小肠

正确答案：A。肺、胃

解析：猩红热（亦可称为“丹痧”）是感受猩红热时邪引起的急性传染病，其病因为猩红热时邪从口鼻侵入人体，蕴于肺胃二经，肺主皮毛，胃主肌肉，邪毒循经外窜肌表，则肌肤透发痧疹，色红如丹（A对）。肺、脾为麻疹、幼儿急疹、水痘、手足口病主要的病变脏腑（B错）。脾、胃为泄泻、厌食、积滞、疳证主要的病变脏腑（C错）。肺、大肠为肺系疾病主要的病变脏腑（D错）。心、小肠为心系或者泌尿系主要的病变脏腑（E错）。